患儿，女，5岁。下乳中切牙Ⅲ度松动，拟行拔除，最佳的表面麻醉药物是
A. 2%地卡因
B. 4%地卡因
C. 2%普鲁卡因
D. 2%利多卡因
E. 2%布比卡因

正确答案：D。2%利多卡因

解析：本题考查局麻药。临床上还可使用2%～5%利多卡因进行表面麻醉（D对），但其麻醉效果不如丁卡因。最常用的表面麻醉药为丁卡因，浓度一般为2%。因丁卡因的毒性较大，儿童应慎用（AB错）。普鲁卡因能产生过敏反应，且临床上已很少使用（C错）。布比卡因儿童应慎用（E错）。